口服给药吸收速率最大的药-时曲线是
A. 曲线②
B. 曲线⑤
C. 曲线①
D. 曲线③
E. 曲线④

正确答案：E。曲线④

解析：本题考查口服给药的吸收曲线。目前临床上应用的大多数小分子药物都遵循一级动力学特征。口服给药时，若药物的吸收与消除均为一级过程，则体内药量随时间的动态过程可表示为：dX/dt=kₐXₐ-kX（Xₐ为吸收部位药量），曲线④⑤均符合口服给药血药浓度-时间曲线，曲线④（E对）先达峰，故口服吸收较快。